分离龙胆苦苷四乙酰化物和獐芽菜苷四乙酰化物用
A. AgNO3硅胶柱色谱
B. 60%～65%H3P04
C. 吉拉尔试剂
D. 氧化铝柱色谱
E. 硅胶柱色谱

正确答案：E。硅胶柱色谱